输血可传播下列哪一种疾病
A. 结核
B. 伤寒
C. 疟疾
D. 钩虫病
E. 甲型肝炎

正确答案：C。疟疾

解析：疟疾是由人类疟原虫感染引起的寄生虫病，主要由雌性按蚊叮咬传播，可因输入带有疟原虫的血液或经母婴传播后发病（C对）。结核病的病原菌结核杆菌主要通过飞沫、尘埃等呼吸道途径传播，不通过输血传播（A错）。伤寒是由伤寒沙门菌引起的一种急性肠道传染病，伤寒沙门菌通过粪-口途径传播，不通过输血传播（B错）。钩虫病是指由钩虫寄生人体小肠所致的疾病，传播途径主要是经皮肤感染，不通过输血传播（D错）。甲型肝炎是由甲型肝炎病毒引起的以肝脏损害为主的全身性传染病，主要由粪-口途径传播，不通过输血传播（E错）。